萎缩性舌炎的常见病因有
A. 不良义齿刺激
B. 发育畸形
C. 口腔环境状况不佳
D. 贫血
E. 精神因素

正确答案：D。贫血

解析：本题考查萎缩性舌炎的病因。萎缩性舌炎的常见病因有贫血（D对）。萎缩性舌炎的病因和发病机制：1.贫血：各型贫血均可引起萎缩性舌炎。若因缺乏内因子所致的恶性贫血，其舌炎称亨特或穆勒舌炎。铁质缺乏引起的低色素性小细胞贫血，若同时伴有吞咽困难和指甲扁平脆化时，称“柏-文综合征”。2.营养物质缺乏：烟酸、维生素B₂、维生素E等缺乏可引起萎缩性舌炎。3.干燥综合征：或称舍格伦综合征，一种主要累及外分泌腺体的慢性炎症性自身免疫病，可累及多个系统。临床除有唾液腺和泪腺受损功能下降而出现口干、眼干外，尚有其他外分泌腺及腺体外其他器官的受累而出现多系统损害的症状。该病患者常出现菱缩性舌炎。4.念珠菌感染：急性红斑型念珠菌病主要表现为舌背乳头团块状萎缩及黏膜的充血。